RNA复制
A. 把DNA的碱基序列变成RNA的碱基序列
B. 此过程常见于人体
C. 以DNA为模板合成RNA的过程
D. 由DNA依赖的RNA聚合酶催化
E. 由RNA依赖的RNA聚合酶催化

正确答案：E。由RNA依赖的RNA聚合酶催化

解析：RNA复制：RNA指导的RNA合成，由RNA依赖的RNA聚合酶催化，常见于病毒。掌握“RNA的生物合成”知识点。